具有直观易懂的优点，且适用于卫生及公共投资决策的是
A. 成本效益分析
B. 成本效果分析
C. 最小成本分析
D. 机会成本法
E. 成本效用分析

正确答案：A。成本效益分析